宏量营养素不包括
A. 糖类
B. 脂类
C. 蛋白质
D. 维生素
E. 碳水化合物

正确答案：D。维生素

解析：本题考查儿童营养基础。维生素(D错，为本题正确答案）不属于宏量营养素，属于微量营养素。营养素分为：宏量营养素（糖类（A对），蛋白质（C对），脂类(B对））；微量营养素（矿物质，包括常量元素和微量元素；维生素）；以及其他膳食成分（膳食纤维，水）。碳水化合物（E对）包括单糖（葡萄糖、双糖）和多糖，为供能的主要来源，属于宏量营养素。